在地面水污染自净过程中，水生生物分解有机物消耗水中氧的同时，水中的氧也可通过某些途径得到补充，使水中的氧达到一定水平，这一过程称为
A. 水中氧的溶解过程
B. 水体的复氧过程
C. 水中氧的消耗过程
D. 水中微生物对有机物的有氧分解过程
E. 水生植物通过光合作用对水的补氧过程

正确答案：B。水体的复氧过程

解析：本题考查水体的复氧过程。在地面水污染自净过程中，水生生物分解有机物消耗水中氧的同时，水中的氧也可通过某些途径得到补充，使水中的氧达到一定水平，这一过程称为水体的复氧过程（B对ACDE错）。